女，29岁。右乳红肿3个月。查体：右乳皮肤红肿，呈桔皮样改变，未触及肿块，右腋窝可触及多个肿大、质硬、融合淋巴结。皮肤活检在真皮淋巴管内查见癌栓，ER、PR阳性，C-erbB2（HER2）阴性。最佳综合治疗顺序是
A. 放疗、手术、化疗、内分泌治疗
B. 内分泌治疗、手术、放疗、化疗
C. 手术、化疗、放疗、内分泌治疗
D. 手术、放疗、化疗、内分泌治疗
E. 化疗、手术、放疗、内分泌治疗

正确答案：E。化疗、手术、放疗、内分泌治疗

解析：青年女性患者，右乳红肿（炎症样表现）3月。体查：右乳皮肤红肿，呈桔皮样改变（真皮水肿，提示皮下淋巴管堵塞），未触及肿块，右腋窝可触及多个肿大、质硬、融合淋巴结（提示肿瘤转移至腋窝淋巴结）。皮肤活检在真皮淋巴管内查见癌栓，ER、PR阳性，C-erbB2（HER2）阴性（提示分化欠佳）。综合该患者的病史、体查及病理学检查，最可能的诊断是炎性乳腺癌。炎性乳腺癌为乳腺癌手术禁忌证（七版黄家驷外科学P1160），本题选项均有误，但参考答案为E。临床上对乳腺癌放、化综合治疗的方式以化、放、化方案（先做三个周期化疗然后放疗，放疗结束后再行三个周期化疗）最优（二版肿瘤放射治疗学P260，人民卫生出版社）。内分泌治疗药物中，他莫昔芬的用法是在患者化学治疗完成后开始服用（二版肿瘤放射治疗学P260，人民卫生出版社），提示内分泌治疗应在化疗完成之后。综上所述，最佳综合治疗顺序是化疗、放疗、化疗、内分泌治疗（E对）。